以下哪项不是人类生态环境保护的道德原则
A. 尊重自然的道德原则
B. 合理利用资源的道德原则
C. 系统综合和同步效应的道德原则
D. 本系统本单位制定运筹规划、落实措施的道德原则
E. 面向未来的道德原则

正确答案：D。本系统本单位制定运筹规划、落实措施的道德原则